对于残疾儿童来讲，在磨牙完全萌出后要尽早进行
A. 预防性树脂充填
B. 牙周洁治
C. 窝沟封闭
D. 非创伤性修复
E. 釉质成形术

正确答案：C。窝沟封闭

解析：对于残疾儿童来讲，窝沟封闭显得更为重要。在磨牙完全萌出后要尽早进行窝沟封闭。掌握“残疾人口腔保健”知识点。